男性患者，55岁，就诊时面容痛苦，诉右上后牙剧痛不敢咬合轻碰即痛。查见：右上6相对根尖区牙龈肿胀，移行沟变浅，扪诊有深部波动感。右上6叩（+++）松Ⅲ度，可探及髓腔，无反应，右上7牙体完好，颊侧可探及根分叉，无法探入，叩（++）松Ⅲ度。右侧面颊肿胀，触痛。关于该患者以下说法正确的是
A. 可有体温升高
B. 淋巴结肿大
C. 血象白细胞增多
D. X片可见根尖透射影
E. 以上都对

正确答案：E。以上都对

解析：本题考查急性根尖周炎骨膜下脓肿的检查。根据患者的临床表现，右上6为急性根尖周炎骨膜下脓肿，右上7牙冠完好，右侧面颊部肿胀，可见右上7为牙周脓肿，两者均有全身症状，尤其根尖周炎骨膜下脓肿疼痛剧烈，全身症状严重。急性根尖周炎骨膜下脓肿检查：（1）患者有痛苦面容，精神疲惫。体温可有升高（A对），约38℃。末梢血象白细胞增多（C对），计数多在10000～12000/mm³。患牙所属区域的淋巴结可出现肿大（B对）和扪痛。（2）患牙叩痛（+++），松动Ⅲ度，牙龈红肿，移行沟变平，有明显的压痛，扪诊深部有波动感。（3）严重的病例可在相应的颌面部出现蜂窝织炎，表现为软组织肿胀、压痛，致使面容改变。（4）急性根尖周脓肿X线检查无明显异常表现，若患牙为慢性根尖周炎急性发作，根尖周牙槽骨显现透射影像（D对）。（ABCD对，故E为本题的正确答案）。